欲测量某地2002年正常成年男子的血糖值，其总体为
A. 该地所有成年男子
B. 该地所有成年男子血糖值
C. 2002年该地所有正常成年男子血糖值
D. 2002年所有成年男子
E. 2002年所有成年男子的血糖值

正确答案：C。2002年该地所有正常成年男子血糖值

解析：本题考查总体的相关内容。总体是根据研究目的确定的同质研究个体的全体，本题研究目的为测量该地2002年正常成年男子的血糖值，因此，总体为2002年该地所有正常成年男子血糖值（C对ABDE错）。